中药材显微鉴定时常制作
A. 横切片
B. 纵切片
C. 表面制片
D. 解离组织片
E. 粉末制片

正确答案：A、B、C、D、E。横切片；纵切片；表面制片；解离组织片；粉末制片

解析：本题考查的是显微制片方法。中药材显微鉴定时常制作横切片（A对）、纵切片（B对）、表面制片（C对）、解离组织片（D对）、粉末制片（E对）。显微制片方法：①横切或纵切片；②解离组织片；③表面制片；④粉末制片；⑤花粉粒与孢子制片；⑥磨片制片；⑦含饮片粉末的中成药显微制片。